男，50岁，慢性肝炎史20年，5年前出现食管黏膜下静脉曲张，3个月前发现肝右叶拳头大肿物，甲胎蛋白阳性，患者的正确诊断是
A. 慢性肝炎
B. 慢性肝炎伴肝硬化
C. 慢性肝炎伴胆管上皮癌
D. 慢性肝炎伴食管静脉曲张
E. 肝硬化伴肝细胞性肝癌

正确答案：E。肝硬化伴肝细胞性肝癌

解析：中年男性患者，慢性肝炎史20年，5年前出现食管黏膜下静脉曲张，考虑诊断慢性肝炎发展为肝硬化。3个月前发现肝右叶拳头大肿物，甲胎蛋白阳性，考虑诊断为肝硬化伴肝细胞性肝癌（E对）。